患者，男，62岁。胸闷痛，心悸盗汗，虚烦不寐，腰膝酸软，头晕耳鸣，舌红少苔，脉沉细数。其治法是
A. 活血化瘀，通脉止痛
B. 益气活血，通脉止痛
C. 益气壮阳，温络止痛
D. 益气养阴，活血通络
E. 滋阴益肾，养心安神

正确答案：E。滋阴益肾，养心安神

解析：病延日久，长期气血运行失畅，瘀滞痹阻故见胸闷痛；不能充润营养五脏，而致心肾阴虚，心阴虚故见心悸盗汗，虚烦不寐；肾阴虚故见腰膝酸软；水不涵木，肝阳偏亢故见头晕耳鸣；舌红少苔，脉沉细数，为胸痹心痛心肾阴虚证之侯，治法为滋阴益肾，养心安神（E对）。活血化瘀，通脉止痛（A错）用于治疗气滞血瘀证。益气活血，通脉止痛（B错）用于治疗气虚血瘀证。益气壮阳，温络止痛（C错）治疗阳虚水泛证。益气养阴，活血通络（D错）治疗气阴两虚证。